以上哪项可破坏胃粘膜屏障的药物是
A. 阿托品
B. 654-2
C. 法莫替丁
D. 硫糖铝
E. 消炎痛

正确答案：E。消炎痛

解析：吲哚美辛即消炎痛通过抑制环氧合酶导致前列腺素的产生减少而削弱其对胃黏膜的保护作用（E对）。阿托品是平滑肌解痉药，可以解除胃痉挛引起的胃痛（A错）。654-2的通用名为山莨菪碱，是一种解痉镇痛药，临床常用于胃肠道的解痉止痛治疗（B错）。法莫替丁为H2受体拮抗药，可抑制胃酸分泌，用于急性胃黏膜病变、胃泌素瘤、反流性食管炎等（C错）。硫糖铝为细胞保护药，有抑制胃蛋白酶和吸附胆盐的作用，主要用于治疗消化性溃疡和慢性胃炎（D错）。